属于健康管理的是
A. 游说进行烟草广告立法
B. 对高血压患者的全面监管
C. 在高危人群中定期检测HIV
D. 残疾患者中假肢、矫正器、轮椅等的应用
E. 定期对成年人进行心血管疾病危险因素评估

正确答案：B。对高血压患者的全面监管

解析：本题考查健康管理。健康管理是对个人或人群的健康危险因素进行全面监管的过程。例如，对高血压患者的全面监管（B对ACDE错）。